男性患者28岁，面部及下肢浮肿，尿蛋白（+++），血压：150/100mmHg，肾穿刺活检：肾小球体积增大，电镜见脏层上皮与基底膜之间有驼峰样致密沉积物。本例肾炎属于：
A. 膜性肾炎
B. 膜性增生性肾炎
C. 毛细血管内增生性肾炎
D. 轻微病变型肾炎
E. IgA肾病

正确答案：C。毛细血管内增生性肾炎

解析：青年患者，面部及下肢浮肿，尿蛋白（+++），血压：150/100mmHg（正常值为90～120/60～90mmHg），肾穿刺活检：肾小球体积增大，电镜见脏层上皮与基底膜之间有驼峰样致密沉积物（毛细血管内增生性肾炎的典型病理表现），根据患者的临床症状及病理检查结果考虑，该患者的诊断为毛细血管内增生性肾炎（C对）。膜性肾炎（A错）电镜观察显示上皮细胞肿胀，足突消失，基膜与上皮之间有大量电子致密沉积物。膜性增生性肾炎（B错）的组织学特点是肾小球基膜增厚、肾小球细胞增生和系膜基质增多。轻微病变型肾炎（D错）光镜下肾小球基本正常，肾小管上皮细胞内有脂质沉积。IgA肾病（E错）电镜检查显示系膜区有电子致密沉积物。